将抽样对象按次序编号，先随机抽取第一个调查对象，然后再按一定间隔随机抽样的是
A. 单纯随机抽样
B. 系统抽样
C. 分层抽样
D. 整群抽样
E. 多级抽样

正确答案：B。系统抽样

解析：系统抽样：又称间隔抽样、机械抽样。将抽样对象按次序编号，先随机抽取第一个调查对象，然后再按一定间隔随机抽样。掌握“口腔健康状况调查的目的、项目、标准及方法”知识点。